能使血液运氧能力降低的气体是
A. 氯气
B. 苯蒸气
C. CO
D. 光气
E. CO₂

正确答案：C。CO